男，34岁。近1个月来多次因阵发性恐惧、胸闷、濒死感在医院急诊科就诊，症状持续约半小时后消失。多次查血常规心电图及头颅CT等未见明显异常。患者为此担心苦恼，但仍能坚持工作。最可能的诊断是
A. 二尖瓣脱垂
B. 甲状腺功能亢进症
C. 广泛性焦虑障碍
D. 疑病障碍
E. 惊恐障碍

正确答案：E。惊恐障碍

解析：该男性患者近1个月来反复出现阵发性恐惧、胸闷、濒死感，持续时间半小时左右，故最可能诊断为惊恐发作（急性焦虑性发作）（E对）。既往体健，血常规心电图及头颅CT等未见明显异常，故排除躯体疾病（二尖瓣脱垂和甲状腺功能亢进）（AB错）。广泛性焦虑障碍（慢性焦虑）以焦虑为主要临床表现，患者没有明确对象的焦急、紧张和恐惧，而少有惊恐发作的典型表现（胸闷濒死感）（C错）。疑病症病前常有过分关注自身健康，可表现为全身不适，疼痛，常四处求医但查无实据，与本例不符（D错）。